女子，阴道口见菜花状赘生物，醋酸白实验阳性，考虑诊断哪种病毒
A. 单纯疱疹病毒
B. 人乳头状瘤病毒
C. 麻疹病毒
D. 巨细胞病毒
E. HIV

正确答案：B。人乳头状瘤病毒

解析：青年女性，外阴出现肿物，阴道口见菜花状肿物（尖锐湿疣的病灶），实验室醋酸白实验阳性，即5%醋酸实验对于诊断尖锐湿疣的价值很大，应首先考虑尖锐湿疣，病原体为人乳头状瘤病（B对）。单纯疱疹病毒感染引起生殖器疱疹生殖器疱疹（A错）主要表现为生殖器及肛门皮肤散在或簇集小水泡，常伴发热，头痛等全身症状。人免疫缺陷病毒（E错）感染引起艾滋病。麻疹病毒，巨细胞病毒均不会引起外阴菜花状赘生物（CD错）。